男，45岁，患高血压，因感冒发热、咽痛、流鼻涕到药店买药，药师不应推荐的药物是
A. 复方酚咖伪麻胶囊
B. 维C银翘片
C. 速克感冒片
D. 速感宁胶囊
E. 对乙酰氨基酚

正确答案：A。复方酚咖伪麻胶囊

解析：本题考查药物的不良反应。复方酚咖伪麻胶囊（A对）中含有伪麻黄碱成分，可引起血管收缩，造成血压升高，因此高血压患者应慎用。